为研究人群高血压患病率及其分布特点，欲对H市15岁以上的居民进行体检并填写健康调查问卷，应采用的调查设计方法是
A. H市所有医院病例报告
B. 生态学研究
C. H市住院或门诊患者普查
D. H市住院或门诊患者抽样调查
E. 现况调查

正确答案：E。现况调查

解析：本题考查现况研究。现况研究是通过对特定时点（或期间）和特定范围内人群中的疾病或健康状况和有关因素的分布状况的资料收集、描述，从而为进一步的研究提供病因线索。研究人群高血压患病率及其分布特点，应采用的调查设计方法是现况研究（E对ABCD错）。